需5℃以下，遮光保存，并避免冻结的药品
A. 低精蛋白胰岛素注射剂
B. 脂肪乳
C. 利福平片
D. 胰酶片
E. 巴曲酶注射剂

正确答案：E。巴曲酶注射剂

解析：本题考查药品的贮存。巴曲酶（E对）需5℃以下，遮光保存，并避免冻结。低精蛋白胰岛素注射剂（A错）需2～10℃冷处保存，并避免冻结。脂肪乳（B错）不宜冷冻。利福平片（C错）应避光保存。胰酶片（D错）需密闭，控制温度，保存中不能受潮。